弹性圆锥
A. 连于甲状软骨与环状软骨之间
B. 下缘游离形成声韧带
C. 前份较厚称环甲正中韧带
D. 上缘附着于环状软骨
E. 后份较薄连于方形膜

正确答案：C。前份较厚称环甲正中韧带

解析：弹性圆锥上缘附着于甲状软骨前角内面（D错），止于杓状软骨声带突和环状软骨上缘（A错E错）。弹性圆锥上缘游离形成声韧带（B错）。弹性圆锥前份较厚称环甲正中韧带（C对）。